《景岳全书·泄泻》云：泄泻之本，无不由于
A. 脾、胃
B. 肝、胆
C. 心、小肠
D. 肺、大肠
E. 肾、膀胱

正确答案：A。脾、胃

解析：该题考查泄泻的病因病机，“泄泻之本，无不由于脾胃”在儿科著作《幼幼集成·泄泻证治》中有提及，原文为“夫泄泻之本，无不由于脾胃”。泄泻的根本原因，在于脾胃，因胃主受纳腐熟水谷，脾主运化水湿和水谷精微，若脾胃受病，则饮食入胃后，水谷不化，精微不布，清浊不分，合污而下，发为泄泻，故（A对）。其余选项与泄泻的发病无关（BCDE错）。